属下运动神经元
A. 脊髓灰质后角
B. 孤束核
C. 前庭神经核
D. 疑核
E. 三叉神经中脑核

正确答案：D。疑核

解析：下运动神经元其细胞位于脊髓前角和脊髓前角的运动神经细胞，其纤维形成脑神经运动纤维，最后形成脑神经运动核（动眼神经核、滑车神经核、展神经核、三叉神经运动核、面神经核支配面上部肌的细胞群、疑核（D对）和副神经脊髓核）。